根据形成苷键原子的不同判定，最容易被酸水解的是
A. 硫苷
B. 氮苷
C. 酯苷
D. 碳苷
E. 氧苷

正确答案：B。氮苷